属于α-葡萄糖酶抑制剂的是
A. 阿卡波糖
B. 二甲双胍
C. 那格列奈
D. 艾塞那肽
E. 吡格列酮

正确答案：A。阿卡波糖

解析：本题考查α-葡萄糖酶抑制剂。阿卡波糖（A对）属于α-葡萄糖苷酶抑制剂。口服降糖药的分类：（1）磺酰脲类促胰岛素分泌药：代表药为格列本脲、格列吡嗪、格列齐特、格列喹酮、格列美脲；（2）非磺酰脲类促胰岛分泌药：代表药为瑞格列奈、那格列奈；（3）双胍类药：二甲双胍；（4）α-葡萄糖苷酶抑制剂：代表药为阿卡波糖、伏格列波糖；（5）胰岛素增敏剂：代表药为罗格列酮、吡格列酮；（6）胰高糖素样肽-1（GLP-1）受体激动剂：代表药为艾塞那肽、利拉鲁肽；（7）二肽基肽酶-4（DPP-4）抑制剂：代表药为西格列汀、阿格列汀。